激动β肾上腺素受体
A. 麻黄碱
B. 异丙肾上腺素
C. 两者均能
D. 两者均不能

正确答案：C。两者均能

解析：本题考查激动β肾上腺素受体的药物。麻黄碱对α-和β-受体均有激动作用，呈现出松弛支气管平滑肌、收缩血管、兴奋心脏等作用。异丙肾上腺素是一种β受体激动剂，对α受体几乎无作用（C对ABD错）。